关于抑郁发作的诊断标准，正确的是
A. 病程应持续3个月以上
B. 自责、内疚，但不能达到妄想程度
C. 特征性睡眠障碍为入睡困难
D. 可出现精神运动性激越
E. 严重者可出现思维贫乏

正确答案：D。可出现精神运动性激越